下列哪项不是月经过少痰湿证的主要临床表现
A. 形体肥胖
B. 胸闷呕恶
C. 带下量多、质粘腻
D. 经期延后、量少
E. 经色黯红、质稠

正确答案：E。经色黯红、质稠

解析：经色黯红，质稠多为血热之象（E对）。月经过少痰湿证，因为痰湿内停，阻滞经络，气血运行不通，血海不足，故经量减少（D错），色淡质黏腻；痰湿内阻，中阳不振，则形体肥胖（A错），胸闷呕恶（B错）；痰湿下注，伤及任带二脉，故带下量多而黏腻（C错）；舌淡，苔腻，脉滑，为痰湿内停之象。